下列哪项不属于艾滋病的口腔黏膜表征
A. 念珠菌病
B. 口腔毛状白斑
C. Kaposi肉瘤
D. 颌骨骨折
E. 非霍奇金淋巴瘤

正确答案：D。颌骨骨折

解析：本题考查艾滋病的口腔表现。颌骨骨折（D错，为本题正确答案）不属于艾滋病的口腔黏膜表征。口腔毛状白斑是最重要的与HIV感染密切相关的口腔病变。艾滋病在口腔还有以下表现：念珠菌病（A对）、口腔毛状白斑（B对）、HIV龈炎及HIV坏死性龈炎、HIV牙周炎、Kaposi肉瘤（C对）、非霍奇金淋巴瘤（E对）。